固本咳喘片除益气固表外，又能
A. 燥湿化痰
B. 化痰通便
C. 健脾补肾
D. 化痰，息风
E. 化痰，止嗽

正确答案：C。健脾补肾

解析：本题考查的是固本咳喘片的功能。固本咳喘片除益气固表外，又能健脾补肾（C对）。固本咳喘片：【功能】益气固表，健脾补肾。二陈丸：【功能】燥湿化痰（A错），理气和胃。清肺抑火丸：【功能】清肺止咳，化痰通便（B错）。半夏天麻丸：【功能】健脾祛湿，化痰息风（D错）。儿童清肺丸：【功能】清肺，解表，化痰，止嗽（E错）。